某女，54岁，体胖少动，因深秋时节，阴雨连绵，突发胃肠疼痛，胸膈满闷，恶心呕吐，纳呆食少，舌苔白腻，脉滑。证属湿浊中阻，脾胃不和，宜选用的成药是
A. 良附丸
B. 四逆汤
C. 香砂平胃丸
D. 小建中合剂
E. 附子理中丸

正确答案：C。香砂平胃丸

解析：本题考查的是香砂平胃丸主治。体胖少动，因深秋时节，阴雨连绵，突发胃肠疼痛，胸膈满闷，恶心呕吐，纳呆食少，舌苔白腻，脉滑。证属湿浊中阻，脾胃不和，宜选用的成药是香砂平胃丸（C对）。香砂平胃丸：【主治】湿浊中阻、脾胃不和所致的胃脘疼痛、胸膈满闷、恶心呕吐、纳呆食少。良附丸（A错）：【主治】寒凝气滞，脘痛吐酸，胸腹胀满。四逆汤（B错）：【主治】阳虚欲脱，冷汗自出，四肢厥逆，下利清谷，脉微欲绝。小建中合剂（D错）：【主治】脾胃虚寒所致的脘腹疼痛、喜温喜按、嘈杂吞酸、食少；胃及十二指肠溃疡见上述证候者。附子理中丸（E错）：【主治】脾胃虚寒所致的脘腹冷痛、呕吐泄泻、手足不温。